淋病的病原体属于
A. 细菌
B. 衣原体
C. 病毒
D. 螺旋体
E. 真菌

正确答案：A。细菌

解析：本题考查常见性传播疾病及其病原体。淋病的病原体是淋病奈瑟菌属于细菌（A对BCDE错），主要相关疾病有：尿道炎、附睾炎、睾丸炎、不育；宫颈炎、子宫内膜炎、输卵管炎、盆腔炎症性疾病、不孕； 直肠炎、咽炎；新生儿结膜炎、角膜瘢痕等。